环境污染的自净是污染物进入环境后
A. 受污染的环境逐渐恢复到污染前的状况
B. 其污染物的理化性质发生了改变
C. 污染物的毒性逐渐降低
D. 污染物的生态效应逐渐降低
E. 对人体健康的危害逐渐减弱

正确答案：A。受污染的环境逐渐恢复到污染前的状况

解析：本题考查环境污染的自净。环境污染的自净是污染物进入环境后受污染的环境逐渐恢复到污染前的状况（A对BCDE错）。